严重心功能不全的中毒患者禁用
A. 洗胃
B. 及时供氧
C. 服用活性炭
D. 先饮大量浓茶
E. 及时服蛋清 处理中药不良反应时

正确答案：A。洗胃